性微寒，可用治淋症，目赤肿痛的药物是
A. 薏苡仁
B. 海金沙
C. 车前子
D. 瞿麦
E. 石韦

正确答案：C。车前子

解析：题中所示选项，除薏苡仁（A错）之外都具有利尿通淋的功效；车前子性味微寒，即能清热利尿通淋，也能渗湿止泻，明目，治疗目赤肿痛（C对）；海金沙性味甘、咸，寒，能清热利湿，通淋之痛，治疗各种淋证，但不能治疗目赤肿痛（B错）；瞿麦性味苦，寒，能利尿通淋，活血通经，治疗淋证，但不能治疗目赤肿痛（D错）；石韦辛味甘、苦，微寒，能利尿通淋，清肺止咳，凉血止血，治疗淋证，但不能治疗目赤肿痛（E错）。